关于子宫内膜癌的转移途径错误的是
A. 宫底部癌灶可经骨盆漏斗韧带淋巴管网向上至腹主动脉旁淋巴结
B. 子宫角部癌灶可沿圆韧带转移至腹股沟淋巴结
C. 盆，腹腔播散种植为最常见途径
D. 血行转移较少见，晚期可至肺，肝，骨骼
E. 下段及宫颈管癌灶可至宫旁闭孔，髂内髂外及髂总淋巴结

正确答案：C。盆，腹腔播散种植为最常见途径

解析：子宫内膜癌的主要转移途径有三种，即直接蔓延、淋巴转移和血行转移。其中最常见的淋巴转移（C错，为本题正确答案）。其中淋巴转移途径与癌肿生长部位有关：宫底部癌灶常沿阔韧带上部淋巴管网经骨盆漏斗韧带转移至腹主动脉旁淋巴结（A对）。子宫角部或前壁上部病灶沿圆韧带淋巴结转移至腹股沟淋巴结（B对）。子宫下段或已累及子宫颈管癌灶可累及宫旁、闭孔、髂内、髂外及髂总淋巴结（E对）。血行转移较少见，晚期可致肺，肝，骨骼等（D对）。